蛋白质生物合成的“装配机”是
A. mRNA
B. tRNA
C. 核糖体
D. 编码氨基酸
E. DNA

正确答案：C。核糖体

解析：蛋白质的生物合成是一个由多种分子参与的复杂过程。20种被编码氨基酸是蛋白质生物合成的基本原料，mRNA、tRNA和核糖体分别是蛋白质生物合成的模板、“适配器”和“装配机”。掌握“蛋白质的生物合成”知识点。